特殊黏膜是
A. 舌腹黏膜
B. 舌背黏膜
C. 软腭黏膜
D. 牙龈
E. 硬腭黏膜

正确答案：B。舌背黏膜

解析：特殊黏膜为舌背黏膜，在功能上属咀嚼黏膜，但又有相当的延伸度，有被覆黏膜的特点。最主要的是其表面有许多不同类型的乳头，部分乳头上皮内还有味觉感受器。掌握“口腔黏膜基本结构”知识点。